过量服用可致脱发、体重增加的药品是
A. 谷维素
B. 色甘酸钠
C. 羧甲司坦
D. 氢溴酸东莨菪碱
E. 硫糖铝

正确答案：A。谷维素